修复前一般主张手术切除的是
A. 倒凹过大的上颌结节
B. 尖锐的骨尖、骨突和骨嵴
C. 增生的黏膜组织
D. 唇、颊系带附着点靠近牙槽嵴顶
E. 以上均是

正确答案：E。以上均是

解析：本题考查全口义齿修复前的外科处理。修复前患者口腔若有倒凹过大的上颌结节（A对），会影响义齿的就位，修复前需要进行手术切除。尖锐的骨突、骨尖和骨嵴（B对）也会形成较大的倒凹造成义齿戴入困难，相应部位黏膜出现压痛，因此较大的骨尖、骨突、骨嵴修复前需要进行手术切除，小的骨尖可以按摩促进其吸收。若增生的黏膜组织（C对）不能消退，影响义齿的稳固，需要采取手术切除，伤口愈合后再重新修复。唇颊系带附着点接近牙槽嵴顶（D对），空气易自基托V形切迹处进入基托和组织之间，破坏了边缘封闭而造成义齿脱位，并常使此处的基托过窄而易折断，最好在修复前进行系带成形术。（ABCD均对，故E为本题的正确答案）。